长期食用甲基汞的人群易得哪种疾病
A. 痛痛病
B. 喘息
C. 水俣病
D. 霍乱
E. 伤寒

正确答案：C。水俣病

解析：水俣病是因食入被有机汞污染河水中的鱼、贝类所引起的甲基汞为主的有机汞中毒，是有机汞侵入脑神经细胞而引起的一种综合性疾病（C对）。痛痛病是因为长期摄入被镉污染食物和水引起（A错）。喘息不是一种病（B错）。霍乱是因摄入的食物或水受到霍乱弧菌污染而引起（D错）。伤寒是由伤寒杆菌引起（E错）。